预防接种史及具体日期应记入
A. 现病史
B. 既往史
C. 个人史
D. 月经及婚育史
E. 家族史

正确答案：B。既往史

解析：本题考查口外病史记录。既往史（B对）：指患者过去的健康和疾病情况。内容包括既往一般健康状况、疾病史、传染病史预防接种史、手术外伤史、输血史、食物或药物过敏史等。